急腹症的病人腹腔内穿刺液为带臭味的血性液，最可能为
A. 肠套叠
B. 绞窄性肠梗阻
C. 急性胰腺炎
D. 胃十二指肠溃疡穿孔
E. 胆囊穿孔

正确答案：B。绞窄性肠梗阻

解析：急腹症的病人腹腔内穿刺液为带臭味的血性液，最可能为绞窄性肠梗阻，是由肠系膜血管受压，导致栓塞或血栓形成。肠管高度膨胀，致肠壁小血管受压影响血供（B对）。肠套叠临床表现不如幼儿典型，往往表现为慢性反复发作，较少发生血便。成人肠套叠多与器质性疾病有关（尤其是肠息肉和肿瘤）（A错）。急性胰腺炎是多种病因导致胰酶在胰腺内被激活后引起胰腺组织自身消化、水肿、出血甚至坏死的炎症反应。临床以急性上腹痛、恶心、呕吐、发热和血胰酶增高等为特点（C错）。胃十二指肠溃疡穿孔，穿孔发生之前数天往往上腹痛加重，一旦溃疡突然穿破，病人顿觉上腹部剧痛，疼痛难以忍受，疼痛可放散至后背或右肩。刺激横膈的顶部，病人觉肩部酸痛；刺激胆囊后方的膈肌与腹膜，病人觉右肩胛骨下方疼痛；刺激小网膜腔，病人仅觉相应下背痛。当胃肠内容弥散至全腹时，则引起全腹持续性剧痛。由于大量胃肠内容是沿右结肠旁沟流至右髂窝，故此处的症状特别明显，易误诊为阑尾炎（D错）。胆囊穿孔是胆道疾病的严重并发症，指因各种原因引起的急性胆囊炎症，或慢性胆囊炎急性发作，胆囊壁充血、水肿，使胆囊壁血循环障碍，出现广泛坏死，同时胆汁淤积、胆囊内压升高，使胆囊膨大致使胆囊穿孔，从而引起不同程度的腹膜炎表现（E错）。